患儿的患牙有深龋，已经穿髓，未见龋洞内出现增生物，且牙髓仍有活力，此特征可以诊断为
A. 急性牙髓炎
B. 慢性溃疡性牙髓炎
C. 慢性增生性牙髓炎
D. 牙髓钙化
E. 牙髓坏死

正确答案：B。慢性溃疡性牙髓炎

解析：慢性溃疡性牙髓炎：探查洞底有穿髓孔，有探痛；对温度测验的反应可迟钝或敏感；叩诊轻度疼痛或不适；X线片检查可有根尖周牙周膜间隙增宽或硬骨板模糊等改变。慢性增生性牙髓炎：多见于青少年的乳、恒磨牙；大而深的龋洞中有红色的肉芽组织（牙髓息肉）充满龋洞；探诊不痛但易出血；冷测敏感或迟缓反应。掌握“乳牙牙髓病及根尖周病诊断及治疗”知识点。